高血压、冠心病、恶性肿瘤、糖尿病、消化性溃疡、哮喘和偏头痛等多种疾病与不良情绪有关，将此类疾病称为
A. 生理疾病
B. 心理疾病
C. 精神疾病
D. 心身疾病
E. 神经疾病

正确答案：D。心身疾病